麻疹早期诊断最有意义的临床表现是
A. 发热、流涕、咳嗽
B. 有感冒接触史
C. 耳后淋巴结肿大
D. 手、足出现红色斑丘疹
E. Koplik斑

正确答案：E。Koplik斑

解析：麻疹早期诊断最有意义的临床表现是Koplik斑（科氏斑）（E对），即麻疹粘膜斑，在麻疹前驱期2～3天，可出现与约90%以上患者口腔中，是麻疹前驱期的特征性体征。发热、流涕、咳嗽（A错）皆为麻疹前驱期的普通表现，不是特征性体征。有感冒接触史（B错）为病史，不是临床表现（P65）。耳后淋巴结肿大（C错）为风疹的常见表现，麻疹少见。手足出现红色斑丘疹（出疹顺序为：首先见于耳后、发际，渐及前额、面、颈部，自上而下至胸、腹、背及四肢，2～3天遍及全身，最后达手掌和足底）（D错）为麻疹出疹期皮疹最后出现的部位，不能用于早期诊断（P65）。